高压蒸汽灭菌法通常在103.4kPa(1.05kg/cm2)的压力下维持时间为
A. 1～5分钟
B. 6～10分钟
C. 15～20分钟
D. 30～40分钟
E. 55～60分钟

正确答案：C。15～20分钟

解析：高压蒸汽灭菌法：可杀灭包括芽胞在内的所有微生物，是灭菌效果最好、应用最广的灭菌方法。方法是将需灭菌的物品放在高压锅内，加热时蒸汽不外溢，高压锅内温度随着蒸汽压的增加而升高。在103.4kPa（1.05kg/cm2）蒸汽压下，温度达到121.3℃，维持15～20分钟。适用于普通培养基、生理盐水、手术器械、玻璃容器及注射器、敷料等物品的灭菌。掌握“消毒与灭菌”知识点。